省（区、市）疾病预防控制机构、疫苗生产企业、疫苗配送企业、疫苗仓储企业的疫苗储存、运输冷链设施设备要求是
A. 普通冷库、冷藏车或者疫苗运输车、低温冰箱、普通冰箱、冷藏箱（包）、冰排和温度监测器材或者设备等
B. 冷藏箱（包）、冰排等
C. 普通冷库、低温冷库、冷藏车和自动温度监测器材或者设备等
D. 普通冰箱、冷藏箱（包）、冰排和温度监测器材或者设备等

正确答案：C。普通冷库、低温冷库、冷藏车和自动温度监测器材或者设备等

解析：本题考查疫苗全程冷链储运管理制度。省（区、市）疾病预防控制机构、疫苗生产企业、疫苗配送企业、疫苗仓储企业的疫苗储存、运输冷链设施设备要求是普通冷库、低温冷库、冷藏车和自动温度监测器材或者设备等（C对）。省级疾病预防控制机构、疫苗生产企业、疫苗配送企业、疫苗仓储企业应当根据疫苗储存、运输的需要，配备普通冷库、低温冷库、冷藏车和自动温度监测器材或设备等。设区的市级、县级疾病预防控制机构应当配备普通冷库、冷藏车或疫苗运输车、低温冰箱、普通冰箱、冷藏箱（包）、冰排和温度监测器材或设备等（A错）。接种单位应当配备普通冰箱、冷藏箱（包）、冰排和温度监测器材或设备等（D错）。